在医疗机构药品采购管理中，关于药品采购品种限制的说法，正确的是
A. 处方组成类同的复方制剂1～2种
B. 同一通用名称药品的品种，注射剂型和口服剂型合计不得超过2种
C. 每种药品剂型原则上不超过2种
D. 药品采购品种限制原则为“两品两规”

正确答案：A。处方组成类同的复方制剂1～2种

解析：本题考查的是医疗机构药品采购品种限制。在医疗机构药品采购管理中，关于药品采购品种限制的说法，正确的是处方组成类同的复方制剂1～2种（A对）。医疗机构应当按照经药品监督管理部门批准并公布的药品通用名称购进药品。同一通用名称药品的品种，注射剂型和口服剂型各不得超过2种（B错），处方组成类同的复方制剂1～2种。因特殊诊疗需要使用其他剂型和剂量规格药品的情况除外。即按照规定，医院除特殊情况外，每一个通用名药品品牌不能超过两个（C错），只允许同一药品，两种规格的存在。对于医疗机构采购品种的限制，称之为“一品两规”（D错），正因为如此，医疗机构应当加强对购进药品品种的管理，选择优质优价的药品。